硝酸甘油舒张血管平滑肌的机制是
A. 激活腺苷酸环化酶，增加cAMP
B. 直接作用于血管平滑肌
C. 激动β₂受体
D. 体内代谢生成NO
E. 阻断Ca²⁺通道

正确答案：D。体内代谢生成NO